女，32岁。剖宫产术后5个月，不哺乳、月经已复潮，但周期不规则，平素经量多，有贫血史，宫颈糜烂。首选避孕方法为
A. 阴茎套
B. 安全期避孕
C. 宫内节育器
D. 输卵管绝育术
E. 口服短效避孕药

正确答案：E。口服短效避孕药

解析：常用的避孕方法有宫内节育器、药物避孕、阴茎套及输精管结扎术等。该患者为育龄女性，剖宫产术后5个月（宫内节育器应在剖宫产术后半年放置），不哺乳、月经已复潮，但周期不规则（月经失调，宫内节育器放置禁忌症），平素经量多，有贫血史，宫颈糜烂，首选避孕方法为口服短效避孕药（E对），口服短效避孕药避孕效果确切，正确使用效率接近100%，安全性较高，且对患者月经过多，周期不规则的症状有治疗作用。阴茎套（A错）正确使用避孕率达93%～95%，还具有防止性传播性疾病的作用，尤其适用于新婚、患心、肝、肾等疾患、变换措施尚处于适应阶段以及可能感染性传播性疾病的高危对象，但由于该患者存在周期不规则和平素经量多的症状，所以口服短效避孕药为最佳选项。宫内节育器（P375-P376）（C错）是我国育龄妇女的主要避孕措施，但该患者宫产术后不足半年且周期不规则，不宜使用。安全期避孕（P381）（B错）又称自然避孕，包括日历表法、基础体温法、宫颈黏液观察法，日历表法适用于周期规则的妇女，基础体温的曲线变化与排卵时间的关系不恒定，宫颈粘液观察需要经过培训才能掌握，因此安全期避孕法并不十分可靠，不宜推广。输卵管绝育术（P382）（D错）适用于接受绝育手术且无禁忌证者，患者育龄妇女，未提出绝育要求。